安钠咖片属
A. 麻醉药品
B. 精神药品
C. 两者都是
D. 两者都不是

正确答案：B。精神药品

解析：本题考查精神药品。安钠咖片属精神药品（B对）。《精神药品品种目录（2013版）》共有149个品种，其中第一类精神药品有68个品种，第二类精神药品有81个品种。安钠咖片属于第二类精神药品。